牙槽间隔的骨嵴顶吸收
A. 水平型骨吸收
B. 垂直型骨吸收
C. 凹坑状吸收
D. 反波浪形骨吸收
E. 弧形骨吸收

正确答案：C。凹坑状吸收

解析：凹坑状吸收：指牙槽间隔的骨嵴顶吸收，其中央部分破坏迅速，而颊舌侧骨质仍保留，形成弹坑状或火山口状缺损。它的形成可能因邻面的龈谷区是菌斑易堆积、组织防御力薄弱的部位，该处的牙槽骨易发生吸收。此外，相邻两牙间的食物嵌塞或不良修复体等也是凹坑状吸收的常见原因。掌握“慢性牙周炎的病因，表现诊断及预后”知识点。